女，23岁。外阴瘙痒、白带增多5天。有不洁性交史。妇科检查：外阴皮肤黏膜充血，小阴唇内侧见多个小菜花状赘生物，宫颈光滑，子宫正常大，附件无异常。最可能的诊断是
A. 淋病
B. 梅毒
C. 尖锐湿疣
D. 外阴阴道念珠菌病
E. 滴虫阴道炎

正确答案：C。尖锐湿疣

解析：青年女性患者，有不洁性交史，出现外阴瘙痒（尖锐湿疣可有外阴瘙痒），小阴唇内侧见多个小菜花状赘生物（病灶初为散在或呈簇状增生的粉色或白色小乳头状疣，细而柔软的指样突起，病变多发生在性交易受损部位，如小阴唇内侧等部位），故最可能的诊断是尖锐湿疣（C对）。淋病（P101）（A错）主要表现为宫颈炎，输卵管炎等炎症表现。梅毒（P102）（B错）早期主要表现为硬下疳、硬化性淋巴结炎、全身皮肤黏膜损害，晚期表现为永久性皮肤黏膜损害，并可侵犯心血管、神经系统等多种组织器官而危及生命。外阴阴道念珠菌病（P249）（D错）主要表现为有凝乳状或豆腐渣样阴道分泌物。滴虫阴道炎（P247）（E错）主要表现为稀薄脓性、黄绿色、泡沫状、有臭味的阴道分泌物增多。ABDE均无赘生物。